原植物属于芸香科的是
A. 地骨皮
B. 香加皮
C. 杜仲
D. 黄柏
E. 合欢皮

正确答案：D。黄柏

解析：本题考查的是黄柏药材的来源。原植物属于芸香科的是黄柏（D对）。黄柏：【来源】为芸香科植物黄皮树的干燥树皮。地骨皮（A错）：【来源】为茄科植物枸杞或宁夏枸杞的干燥根皮。香加皮（B错）：【来源】为萝藦科植物杠柳的干燥根皮。杜仲（C错）：【来源】为杜仲科植物杜仲的干燥树皮。合欢皮（D错）：【来源】为豆科植物合欢的干燥树皮。